男，51岁。胸骨后剧烈疼痛伴大汗淋漓4小时。血压80/40mmHg，心率134次/分，面色苍白，四肢发冷。心电图提示广泛心肌梗死。有指导性意义的辅助检查是
A. 心电图和血压检测
B. 心肌酶谱检测
C. 漂浮导管血流动学检测
D. 超声心动图
E. 胸部X线

正确答案：B。心肌酶谱检测

解析：患者中年男性，突发剧烈疼痛伴大汗淋漓，心电图提示广泛心肌梗死，考虑诊断为急性心肌梗死。血清心肌坏死标记物增高水平与心肌坏死范围及预后明显相关。其中心肌酶谱检测中的肌酸激酶同工酶CK-MB在起病后4小时内即可增高，其增高的程度能较准确地反映梗死的范围，其高峰出现时间是否提前有助于判断溶栓治疗是否成功。因此有指导性意义的辅助检查是心肌酶谱检测（B对）。心电图和血压检测（A错）常有进行性的改变，对MI的诊断、定位、定范围、估计病情演变和预后都有帮助，但其灵敏性和准确性不如心肌酶谱检测，故并非本题最佳答案。漂浮导管血流动学检测（C错）可反映心肌梗死后的左心室的功能，超声心动图（D错）也有助于了解心室壁的运动和左心室功能，胸部X线（E错）有助于了解其他心肺情况，如有无心脏增大、充血性心力衰竭等，但后三种辅助检查对心肌梗死的诊断和治疗均无指导性意义。